物理量的单位符号为：压力
A. kPa
B. Pa·S
C. mm²/s
D. cm⁻¹
E. ㎛

正确答案：A。kPa